医疗机构从业人员理想的人格形象是
A. 大医精诚
B. 以患者为中心
C. 人道行医
D. 为人民健康服务
E. 救死扶伤

正确答案：A。大医精诚

解析：大医风范是一种崇高医德人格，用孙思邈的话加以高度概括，就是“大医精诚”。大医精诚中的精是指医术修养达到高超水准，诚是指医德修养进人高尚境界，因此医疗机构从业人员理想的人格形象是大医精诚（A对）。